李女士来到药房咨询，主诉最近服用下列药品后体重有所增加，请药师确认可能增加体重的药品是
A. 二甲双胍
B. 辛伐他汀
C. 米氮平
D. 阿司匹林
E. 硝酸甘油

正确答案：C。米氮平

解析：本题考查米氮平。李女士来到药房咨询，主诉最近服用下列药品后体重有所增加，请药师确认可能增加体重的药品是米氮平（C对）。米氮平常见体重增加、困倦等不良反应。二甲双胍（A错）为口服降糖药，常见不良反应有食欲下降、恶心、呕吐等消化道反应，严重者可出现酮尿或乳酸血症等。辛伐他汀（B错）为调血脂药，常见不良反应有肌痛、肌病，横纹肌溶解症等。阿司匹林（D错）为非甾体解热镇痛抗炎药，常见不良反应有胃肠道反应、凝血障碍、变态反应、水杨酸反应等。硝酸甘油（E错）为抗心绞痛药，常见不良反应有面部潮红、搏动性头痛、直立性低血压等。